主要用于高血压及心绞痛治疗，主要不良反应为外周水肿的药物是
A. 普萘洛尔
B. 哌唑嗪
C. 甲基多巴
D. 氨氯地平
E. 尼群地平

正确答案：D。氨氯地平

解析：本题考查氨氯地平。主要用于高血压及心绞痛治疗，主要不良反应为外周水肿的药物是氨氯地平（D对）。氨氯地平为第三代二氢吡啶类的长效钙通道阻滞药。对血管的舒张作用缓和而持久，降压作用平稳，用于心绞痛治疗时不易致反射性心动过速，适用于慢性稳定型心绞痛和变异型心绞痛的预防治疗。二氢吡啶类钙通道阻滞剂常见不良反应包括：反射性交感神经激活导致心跳加快、面部潮红、脚踝部水肿、牙龈增生等。普萘洛尔（A错）用于治疗各种程度的原发性高血压，可单独使用，也可与其他抗高血压药合用。可治疗稳定型及不稳定型心绞痛，可减少发作次数，对兼患高血压或心律失常者更为适用。常见的不良反应有疲乏、肢体冷感、激动不安、胃肠不适等，长期应用者突然停药可发生反跳现象。哌唑嗪（B错）适用于各型高血压，单用治疗轻、中度高血压，重度高血压合用利尿药和β受体阻断药可增强降压效果。甲基多巴（C错）为中枢降压药。尼群地平（E错）为二氢吡啶类钙通道阻滞剂。具有显著而持久的降压及血管扩张作用。用于原发性高血压、继发性高血压及冠心病的治疗。